可影响氯吡格雷代谢的药品是
A. 铝碳酸镁咀嚼片
B. 多潘立酮片
C. 奥美拉唑肠溶胶囊
D. 乳果糖口服溶液
E. 巴氯芬片

正确答案：C。奥美拉唑肠溶胶囊

解析：本题考查药物的相互作用。可影响氯吡格雷代谢的药品是奥美拉唑肠溶胶囊（C对）。奥美拉唑是CYP2C19强抑制剂，氯吡格雷为前药，体内经CYP2C19代谢发挥抗血小板作用，两者同服，会降低氯吡格雷的疗效。铝碳酸镁咀嚼片（A错）可用于胃食管反流病患者胸痛偶发。多潘立酮（B错）为促胃肠动力的药物，有促进脑垂体泌乳素释放的作用，在胃肠道出血、机械性肠梗阻、胃肠穿孔、分泌催乳素的垂体肿瘤患者禁用。乳果糖口服溶液（D错）在结肠中被消化道菌丛转化成低分子量有机酸，故乳酸血症患者服用乳果糖可加重酸中毒，因此乳果糖禁用于乳酸血症患者。巴氯芬片（E错）能通过血-脑屏障，引起头晕、恶心等中枢神经系统不良反应。巴氯芬和降压药合用可使血压下降作用加强。